作用于强心苷内酯环的反应有
A. 盐酸+Mg
B. 亚硝酰铁氰化钠
C. 3,5-二硝基苯甲酸
D. 间二硝基苯
E. 对硝基苯胺

正确答案：B、C、D。亚硝酰铁氰化钠；3,5-二硝基苯甲酸；间二硝基苯

解析：本题考查的是强心苷C-17位上不饱和内酯环的颜色反应。作用于强心苷内酯环的反应有亚硝酰铁氰化钠（B对）、3,5-二硝基苯甲酸（C对）与间二硝基苯（D对）。C-17位上不饱和内酯环的颜色反应：①Legal反应：又称亚硝酰铁氰化钠试剂反应。②Raymond反应：又称间二硝基苯试剂反应。③Kedde反应：又称3,5-二硝基苯甲酸试剂反应。④Baljet反应：又称碱性苦味酸试剂反应。盐酸+Mg（A错）为黄酮类化合物的颜色反应。黄酮的盐酸-镁粉（或锌粉）反应：是鉴定黄酮类化合物最常用的颜色反应。多数黄酮、黄酮醇、二氢黄酮及二氢黄酮醇类化合物显橙红色至紫红色，少数显紫色至蓝色。但查尔酮、橙酮、儿茶素则无该显色反应。异黄酮类化合物除少数例外，也不显色。对硝基苯胺（E错）为α-去氧糖的颜色反应。α-去氧糖颜色反应：α-去氧糖颜色反应共有四个鉴别反应：①K-K反应；②呫吨氢醇反应；③对-二甲氨基苯甲醛反应；④过碘酸钠-对硝基苯胺反应。